胃溃疡外科手术治疗的适应证是
A. 内科治愈后短期复发
B. 腹痛周期性发作
C. 年龄小于45岁
D. 溃疡直径小于1cm
E. 幽门螺杆菌反复感染

正确答案：A。内科治愈后短期复发

解析：大多数胃溃疡可经保守治疗治愈，但对于内科治愈后短期复发（A对）、胃溃疡并发穿孔、出血、幽门梗阻、癌变及巨大溃疡（直径＞2.5cm）或高位溃疡的患者需行外科手术治疗。年龄小于45岁（C错）、溃疡直径小于1cm（D错）的患者应选择内科保守治疗。腹痛呈周期性发作（B错）为胃溃疡的常见临床表现，不是其外科手术治疗的适应证。幽门螺杆菌反复感染（E错）与溃疡的复发有关。